外呼吸指
A. 肺与血液的气体交换
B. 外界环境与气道间气体交换
C. 肺毛细血管血液与外界环境间气体交换
D. 外界O₂进入肺的过程
E. 体内CO₂出肺的过程

正确答案：C。肺毛细血管血液与外界环境间气体交换